实行药品政府指导价，其地方定价目录的制定机关是
A. 国家药品监督管理部门
B. 省级人民政府价格主管部门
C. 国务院价格主管部门
D. 县级人民政府价格主管部门
E. 地（市）级药品监督管理部门

正确答案：B。省级人民政府价格主管部门